紫花洋地黄苷A用温和酸水解得到产物是
A. 洋地黄毒苷元+2分子D-洋地黄毒糖+洋地黄双糖
B. 洋地黄毒苷元+3分子D-洋地黄毒糖+D-葡萄糖
C. 洋地黄毒苷元+（D-洋地黄毒糖）2+D-葡萄糖
D. 洋地黄毒苷元+（D-洋地黄毒糖）3+D-葡萄糖
E. 洋地黄毒苷元+1分子D-洋地黄毒糖+（D-洋地黄毒糖-葡萄糖）

正确答案：A。洋地黄毒苷元+2分子D-洋地黄毒糖+洋地黄双糖

解析：本题考查的是强心苷的温和酸水解。紫花洋地黄苷A用温和酸水解得到产物是洋地黄毒苷元+2分子D-洋地黄毒糖+洋地黄双糖（A对）。强心苷的温和酸水解：用稀酸如0.02～0.05mol/L的盐酸或硫酸，在含水醇中经短时间加热回流，可使Ⅰ型强心苷水解为苷元和糖。因为苷元和α-去氧糖之间、α-去氧糖与α-去氧糖之间的糖苷键极易被酸水解，在此条件下即可断裂。而α-去氧糖与α-羟基糖、α-羟基糖与α-羟基糖之间的苷键在此条件下不易断裂，常常得到二糖或三糖。由于此水解条件温和，对苷元的影响较小，不致引起脱水反应，对不稳定的α-去氧糖亦不致分解。此法不宜用于16位有甲酰基的洋地黄强心苷类的水解，因16位甲酰基即使在这种温和的条件下也能被水解。紫花洋地黄苷A经温和酸水解的产物是洋地黄毒苷元+2分子D-洋地黄毒糖+洋地黄双糖。